下列哪项不属于氨基糖苷类药物的不良反应
A. 变态反应
B. 神经肌肉阻断作用
C. 肾毒性
D. 骨髓抑制
E. 耳毒性

正确答案：D。骨髓抑制